前筛窦开口于
A. 上鼻道
B. 中鼻道
C. 蝶筛隐窝
D. 筛漏斗
E. 下鼻道

正确答案：B。中鼻道

解析：前筛窦…开口于中鼻道（B对）。